某小学，6月一次中午进食火腿、汉堡包、粥、煮鸡蛋、炒空心菜、萝卜干，4小时后部分同学出现头痛恶心呕吐食欲不振腹泻腹痛，个别有发热，体温38～40℃。引起食物中毒的食品可能是
A. 火腿汉堡包
B. 粥
C. 煮鸡蛋
D. 炒空心菜
E. 萝卜干

正确答案：A。火腿汉堡包

解析：火腿汉堡包（A对）中火腿属于是畜肉类制品。引起沙门菌食物中毒的食品主要为动物性食品，特别是畜肉类及其制品。粥（B错）、炒空心菜（D错）、萝卜干（E错）三者不易出现沙门菌中毒。本题易错选煮鸡蛋（C错），蛋类食品多因家禽带菌而感染沙门菌，但在加工制作过程中，绝大多数沙门菌可因高温加热而被杀死，故食用者并不易出现沙门菌中毒。